咬肌间隙感染最常见的病灶牙是
A. 下颌尖牙
B. 上颌尖牙
C. 下颌第一磨牙
D. 下颌第三磨牙
E. 上颌第三磨牙

正确答案：D。下颌第三磨牙

解析：本题考查咬肌间隙感染最常见的病灶牙。咬肌间隙感染最常见的病灶牙是下颌第三磨牙（D对），也可来自于下颌磨牙的根尖周炎、牙槽脓肿，或相邻的间隙感染扩散。下颌尖牙（A错）多为舌下间隙或颏下间隙感染的病灶牙。上颌尖牙（B错）、第一前磨牙和上颌切牙多为眶下间隙感染的病灶牙。下颌第一磨牙（C错）多为颊间隙、下颌下间隙或翼下颌间隙感染的病灶牙。上颌第三磨牙（E错）多为颊间隙或颞下间隙感染的病灶牙。